依照《中华人民共和国药品管理法》，中药饮片的炮制，国家药品标准没有规定的必须按照
A. 县级以上药品监督管理部门制定的炮制规范炮制
B. 地方药品标准规定炮制
C. 省级人民政府药品监督管理部门制定的炮制规范炮制
D. 国家中医药管理局制定的炮制规范炮制
E. 行业药品标准规范炮制

正确答案：C。省级人民政府药品监督管理部门制定的炮制规范炮制

解析：本题考查的是国家药品标准的定义。依照《中华人民共和国药品管理法》，中药饮片的炮制，国家药品标准没有规定的必须按照（C对）。国家药品标准的定义：国家药品标准是国家对药品质量要求和检验方法所做的技术规定，是药品生产、供应、使用、检验和管理共同遵循的法定依据。《药品管理法》规定，药品应当符合国家药品标准。经国务院药品监督管理部门核准的药品质量标准高于国家药品标准的，按照经核准的药品质量标准执行；没有国家药品标准的，应当符合经核准的药品质量标准。国务院药品监督管理部门颁布的《中华人民共和国药典》和药品标准为国家药品标准。《药品管理法》还规定，中药饮片必须按照国家药品标准炮制；国家药品标准没有规定的，必须按照省级药品监督管理部门制定的炮制规范炮制。省级药品监督管理部门制定的炮制规范应当报国家药品监督管理部门备案。